消毒窝洞理想的药物应该是
A. 消毒力弱、刺激性小、不损伤深层牙髓活力
B. 刺激性小、渗透性小、向深层组织侵袭
C. 刺激性大、消毒力强，足以杀灭细菌
D. 消毒力强、刺激性小，渗透性小，不使牙体组织变色
E. 消毒力适中、刺激性小，渗透性强，不使牙体组织变色

正确答案：D。消毒力强、刺激性小，渗透性小，不使牙体组织变色

解析：本题考查理想的窝洞消毒药的特征。窝洞制备完毕充填前，可选用适宜的药物进行窝洞消毒，杀灭细菌防止继发龋，理想的窝洞消毒药应具有消毒力强，渗透性小，对牙髓刺激小和不使牙变色等特征（D对）。